重组人促红素的适应证是
A. 缺铁性贫血
B. 巨幼细胞贫血
C. 血小板减少性紫癜
D. 中性粒细胞减少症
E. 肾功能不全所致的贫血

正确答案：E。肾功能不全所致的贫血

解析：本题考查重组人促红素。重组人促红素的适应证是肾功能不全所致贫血（E对），包括透析及非透析患者及外科围手术期的红细胞动员。